下列哪一项是链球菌感染证据
A. 抗“O”大于500U
B. 血沉加快
C. CRP阳性
D. 扁桃体炎
E. 白细胞数增高

正确答案：A。抗“O”大于500U

解析：人体中抗“O”（SLO抗体）显著增加，其效价在1：400以上，可作为链球菌新近感染指标之一或风湿热及其活动性的辅助诊断，因此抗“O”大于500U（A对）是链球菌感染证据。血沉加快（B错）可见于一些生理情况，如女性经期、妊娠期等，病理情况可见于各种急、慢性炎症、恶性肿瘤等情况，但对链球菌感染无特异性。CRP阳性（C错）可见急性炎症和感染，不受放疗、化疗、糖皮质激素治疗的影响，但对但对链球菌感染无特异性。扁桃体炎（D错）可由致病菌（主要为链球菌或葡萄球菌）感染所致，也可继发于某些急性传染病，如猩红热、白喉、流感、麻疹等，因此不能作为链球菌感染的证据。白细胞数增高（E错）常见于各类急、慢性感染等多种疾病，对链球菌的感染无特异性。